可导致耳毒性，主要表现为耳聋的药物是
A. 环孢素
B. 利福平
C. 依他尼酸
D. 银杏叶制剂
E. 硫酸软骨素

正确答案：C。依他尼酸

解析：本题考查药源性疾病。依他尼酸（C对）可引起听神经障碍（主要为耳聋）。环孢素（A错）具有肾毒性。利福平（B错）具有肝毒性。银杏叶制剂（D错）会增大出血的倾向。硫酸软骨素（E错）无明显的毒副作用。